男，35岁。右上第一磨牙牙髓治疗后劈裂，拔牙过程中牙冠碎裂至龈下，牙根与周围骨质粘连，此时拔除此根应先分根后拔除。拔牙过程中发现其腭侧根消失，牙槽窝空虚，此时应当
A. 立即停止操作，拍X线片
B. 立即扩大牙槽窝取根
C. 立即行上颌窦开窗取根
D. 翻瓣去骨取根
E. 延期拔除患牙

正确答案：A。立即停止操作，拍X线片

解析：上6距上颌窦底的距离最近，窦底与牙根之间的骨质可能极薄，甚至仅靠黏膜与窦腔隔开，由此形成了牙根易移位的薄弱点，拔牙时，第一磨牙的腭侧根极易发生移位，此种情况应用X线（A对）确定牙根位置再选择入路，以免造成不必要的伤害。不能判断牙根的位置，如牙根已完全进入上颌窦，立即扩大牙槽窝取根（B错）会使创伤更大。如牙根能在可见的视野内可见，不需要行上颌窦开窗取根（C错），用止血钳或刮匙将其取出即可。要根据牙根所在位置选择牙槽骨入路，直接选择翻瓣去骨法（D错），对组织创伤大。延期拔出患牙（E错）会导致上颌窦感染，造成更大的伤害。